下列疾病中能自行缓解的是
A. 寻常型天疱疮
B. 瘢痕性类天疱疮
C. 糜烂型扁平苔藓
D. 大疱性类天疱疮
E. 大疱性表皮松解症

正确答案：D。大疱性类天疱疮

解析：本题考查大疱性类天疱疮。大疱性类天疱疮（D对）口腔损害多在皮损出现后出现，病损较轻，疱夜饱满，疱破溃后能自行缓解。寻常型天疱疮（A错）疱壁薄而易破，不易愈合，经治疗部分病例可缓解，死亡率21.4%。瘢痕性类天疱（B错）疮慢性迁延，眼部形成瘢痕可致失明。糜烂型扁平苔藓（C错）需经局部治疗和全身治疗激素治疗后才能愈合，不能自行缓解，易复发，易癌变。大疱性表皮松解症（E错），需全身应用糖皮质激素治疗后，部分病例才能愈合，不能自行缓解。